既行气止痛，又温肾散寒的药是
A. 木香
B. 甘松
C. 佛手
D. 青皮
E. 乌药

正确答案：E。乌药

解析：本题考查的是乌药的功效。既行气止痛，又温肾散寒的药是乌药（E对）。乌药：【功效】行气止痛，温肾散寒。木香（A错）：【功效】行气止痛，健脾消食。甘松（B错）：【功效】行气止痛，开郁醒脾。佛手（C错）：【功效】疏肝理气，和中，化痰。青皮（D错）：【功效】疏肝破气，消积化滞。